其共轭酸的分子内氢键稳定的是
A. 小檗碱
B. 麻黄碱
C. 伪麻黄碱
D. 东莨菪碱
E. 山莨菪碱

正确答案：C。伪麻黄碱

解析：本题考查的是伪麻黄碱的碱性。其共轭酸的分子内氢键稳定的是伪麻黄碱（C对）。麻黄碱（B错）和伪麻黄碱为有机仲胺衍生物，碱性较强。由于伪麻黄碱的共轭酸与C₂-OH形成分子内氢键，稳定性大于麻黄碱。所以伪麻黄碱的碱性稍强于麻黄碱。小檗碱（A错）属季铵型生物碱，可离子化而呈强碱性。东莨菪碱（D错）由于6、7位氧环立体效应和诱导效应的影响，碱性较弱。山莨菪碱（E错）分子中6位羟基的立体效应影响较东莨菪碱小，故其碱性介于莨菪碱和东莨菪碱之间。